牙本质中龋时，牙本质牙髓复合体产生的变化是
A. 牙髓充血
B. 牙髓慢性炎症
C. 牙髓变性
D. 继发性牙本质形成
E. 修复性牙本质形成

正确答案：E。修复性牙本质形成

解析：本题考查中龋时牙本质牙髓复合体的变化。中龋时牙髓牙本质复合体受到刺激，可形成修复性牙本质（E对）。深龋时牙髓组织受到刺激可引起牙髓充血（A错），或轻度的牙髓慢性炎症反应（B错）。当牙髓血供不足时，可造成牙髓组织营养不良，长时间可使牙髓细胞变性坏死（C错）。继发性牙本质是牙根发育完成、牙与咬合牙建立咬合关系后形成的牙本质，是生理状态下发生的（D错）。